男性，62岁。近3个月来逐渐出现上腹不适，进食后饱胀，嗳气，纤维胃镜发现大弯侧胃壁上1cm大小块状肿物，与周围组织界限较为清楚，病理提示恶性。如行根治手术，可以保留的淋巴结
A. 沿胃小弯淋巴结
B. 贲门右区淋巴结
C. 幽门下区淋巴结
D. 腹主动脉旁淋巴结
E. 贲门左区淋巴结

正确答案：D。腹主动脉旁淋巴结

解析：老年男性患者，因上腹不适，进食后饱胀、嗳气来诊，纤维胃镜见大弯侧胃壁上lcm大小的块状肿物，与周围组织界限较为清楚，病理提示恶性，结合患者病史和胃镜检查，应考虑为BorrmannⅠ型进展期胃癌。进展期胃癌行根治性手术时，需清除第一、二站淋巴结。引流胃的区域淋巴结有16组，依据它们距胃的距离可分为3站。第一站淋巴结按照贲门右区淋巴结（B错）、贲门左区淋巴结（E错）、胃小弯淋巴结（A错）、胃大弯淋巴结、幽门上淋巴结、幽门下淋巴结（C错）的顺序编为1～6组。腹主动脉旁淋巴结为第16组淋巴结，依据不同部位胃癌各站淋巴结的划分（八版外科学P362表34-1），该患者第二站淋巴结不包括第16组淋巴结，因此该患者行根治手术治疗时，可保留腹主动脉旁淋巴结（D对）。